99mTc核素显像呈“热”结节的是
A. 多形性腺瘤
B. 腺样囊性癌
C. 沃辛瘤
D. 黏液表皮样癌
E. 圆柱瘤

正确答案：C。沃辛瘤

解析：沃辛瘤：99mTc核素显像呈“热”结节，具有特征性。掌握“沃辛瘤”知识点。